患者，男性，60岁。高血压病史近20年，经检查：心室肌肥厚，血压：170/100mmHg。最好选用哪种降压药
A. 氢氯噻嗪
B. 可乐定
C. 卡托普利
D. 维拉帕米
E. 普萘洛尔

正确答案：C。卡托普利